引起急性龈乳头炎的直接原因是
A. 食物嵌塞
B. 不适当的使用牙签
C. 充填体的悬突
D. 不良修复体的边缘
E. 以上都是

正确答案：E。以上都是

解析：牙龈乳头受到机械或化学的刺激，是引起急性龈乳头炎的直接原因。掌握“急性龈乳头炎”知识点。